主导管无异常改变或表现为轻度扩张；分支导管稀少；末梢导管呈点状、球状、腔状扩张，可诊断为
A. 慢性阻塞性腮腺炎
B. 慢性复发性腮腺炎
C. 舍格伦综合征
D. 唾液腺结石病
E. 涎瘘

正确答案：B。慢性复发性腮腺炎

解析：慢性复发性腮腺炎，可发生于儿童或成人，多自儿童期发病，到青春期后仍未痊愈，则成为成人复发性腮腺炎。腮腺造影表现为主导管无异常改变或表现为轻度扩张；分支导管稀少；末梢导管呈点状、球状、腔状扩张；排空功能迟缓。病变可累及副腺体。随着年龄增长，临床发作次数减少，末梢导管扩张数目也逐渐减少，直至完全消失。下颌下腺未见明显影像学异常。掌握“唾液腺及颞下颌关节疾病”知识点。